患者，女，30岁。家人发现神志不清2小时，双瞳孔缩小，呼气有大蒜味，可能的病因是
A. 脑出血
B. 脑炎
C. 有机磷农药中毒
D. 安眠药中毒
E. 脑膜炎

正确答案：C。有机磷农药中毒

解析：有机磷农药中毒口服出现于10分钟到2小时，出现毒蕈碱样症状，主要是副交感神经兴奋所致的平滑肌痉挛和腺体分泌增多。临床表现为恶心、呕吐、腹痛、腹泻、流涎、支气管痉挛及分泌物增多等。严重时发生肺水肿，还可引起心跳减慢，瞳孔缩小，视力模糊等。烟碱样症状病人皮肤血管收缩，面色苍白，心率增快，血压增高，早期可出现面部及四肢胸腹部的肌束颤动，晚期可出现肌阵挛或肌麻痹。可因呼吸肌麻痹而致死。中枢神经系统症状早期可有头晕、头痛、倦怠无力，进而出现烦躁不安、谵妄、抽搐及昏迷。严重时可发生呼吸中枢衰竭或脑水肿而死亡（C对）。脑出血多表现为嗜睡和昏迷，瞳孔不等大，呕吐，头晕头痛等（A错）。脑炎主要为发热，抽搐，惊厥，意识障碍，昏迷，恶心呕吐等（B错）。安眠药中毒表现为嗜睡，昏迷，瞳孔缩小，呼吸减慢不规则，血压下降，恶心呕吐，全血细胞减少等（D错）。脑膜炎表现为感染症状，脑膜刺激征，颅内压升高（E错）。